患者阵发性室上性心动过速，发作时心率可高达200，伴有胸痛，机制是
A. 舒张期缩短
B. 收缩期缩短
C. 冠心病
D. 主动脉收缩压升高
E. 主动脉舒张压升高

正确答案：A。舒张期缩短

解析：当心率在一定范围内增加时，可增加心输出量，当心率过快时（＞180次/分），心动周期缩短，且心室舒张期时间更为缩短，导致心室充盈时间缩短，静脉回心血量减少，心输出量减少，引发胸痛（A对）。